患者，男，42岁。喘逆上气，咳痰不爽，痰质稠、色黄，恶寒身热，无汗，舌红苔黄，脉浮滑而数。治疗应首选
A. 麻杏石甘汤
B. 黄连解毒汤
C. 清金化痰汤
D. 银翘散
E. 桑白皮汤

正确答案：A。麻杏石甘汤

解析：本病例以喘逆上气为主诉，故诊断为喘证；因寒邪束表，肺有郁热，或表寒未解，内已化热，热郁于肺，肺气上逆，则喘逆上气，咳痰不爽；热灼津液成痰，则痰质稠、色黄；热为寒郁，则恶寒身热，无汗；舌红苔黄，脉浮滑而数，为表寒肺热夹杂之象，故诊断为表寒肺热证，治以解表清里，化痰平喘，代表方为麻杏石甘汤（A对）。黄连解毒汤，其功用为泻火解毒，适用于三焦火毒证(B错)。清金化痰汤，其功用为清热化痰，可用于内伤咳嗽之痰热郁肺证（C错）。银翘散，其功用为辛凉解表，可用于感冒之风热犯表证（D错）。桑白皮汤，其功用为清热肃肺化痰，可用于喘证之痰热郁肺证（E错）。